室内空气污染物中哪个与肺癌发病密切
A. 甲醛
B. SO₂
C. NOx
D. 氡
E. CO

正确答案：D。氡

解析：本题考查与肺癌发病密切的室内空气污染物。氡是一种放射性室内空气污染物，它与肺癌发病有着特殊的关系，研究发现，长期接触氡污染空气的人群，患肺癌的风险会大大增加。有研究发现，氡污染空气中的每增加100Bq/m³，患肺癌的风险就会增加1.04倍。因此，氡（D对ABCE错）是室内空气污染物中与肺癌发病密切相关的污染物。